下列哪项不影响体温的生理变动
A. 昼夜变动
B. 性别差异
C. 情绪变化
D. 年龄差异
E. 体重差异

正确答案：E。体重差异